沉降性所示的作用是
A. 潜阳
B. 发表
C. 祛风
D. 涌吐
E. 开窍

正确答案：A。潜阳

解析：本题考查的是升降浮沉的所示效用。沉降性所示的作用是潜阳（A对）。升和浮、沉和降，都是相对的。升是上升，降是下降，浮表示发散向外，沉表示收敛固藏和泻利等。一般说，升浮类药能上行向外，分别具有升阳发表（B错）、祛风（C错）散寒、涌吐（D错）、开窍（E错）等作用；沉降类药能下行向内，分别具有泻下、清热、利水渗湿、重镇安神、潜阳息风、消积导滞、降逆止呕、收敛固涩、止咳平喘等作用。